不是上肢浅静脉的是
A. 桡静脉
B. 头静脉
C. 贵要静脉
D. 肘正中静脉
E. 手背静脉网

正确答案：A。桡静脉

解析：桡静脉（A错，为本题正确答案）为上肢深静脉。头静脉（B对）、贵要静脉（C对）、肘正中静脉（D对）、手背静脉网（E对）均为上肢浅静脉。